重复用药后，机体对药物的反应性逐渐减弱的现象，称为
A. 继发反应
B. 耐受性
C. 耐药性
D. 特异质反应
E. 药物依赖性

正确答案：B。耐受性

解析：本题考查耐受性。重复用药后，机体对药物的反应性逐渐减弱的现象，称为耐受性（B对）。耐受性是指在连续用药过程中，有的药物的药效会逐渐减弱，需加大剂量才能显效的现象。继发反应（A错）是继发于药物治疗作用之后的不良反应，是治疗剂量下治疗作用本身带来的间接结果。耐药性（C错）系指在化学治疗中，病原体或肿瘤细胞对化疗药物的敏感性降低的现象。特异质反应（D错）是指少数特异体质患者对某些药物反应异常敏感。药物依赖性（E错）是在长期应用某种药物后所造成的一种强迫要求连续或定期使用该药的行为或其他反应，其目的是感受药物的精神效应，或避免由于停药造成身体不适。